耳穴“脾”位于
A. 耳舟
B. 耳轮
C. 耳甲
D. 耳垂
E. 三角窝

正确答案：C。耳甲

解析：该题考查耳穴的部位，五脏的耳穴均位于耳甲区，脾位于耳甲腔的后上部（C对）。